患儿男，1岁4个月，家长为预防幼儿缺钙，每日给患儿服用维生素D5000IU，3个月后患儿出现乏力、恶心、呕吐、食欲不振等症状，化验结果：血钙18mg/dl，25-OH-D₃水平632ng/m1。诊断为维生素D中毒，下列处理措施错误的是
A. 停用维生素D及强化食品
B. 停饮牛奶
C. 停用钙剂
D. 增加日晒
E. 多饮水

正确答案：D。增加日晒

解析：本题考查维生素D中毒。维生素D中毒处理措施错误的是增加日晒（D错，为本题正确答案）。维生素D中毒后处理：立即停止维生素D及其强化食品和钙剂（C对），停饮牛奶（B对）改豆浆，泼尼松2mg/（kg·d），口服；降钙素50～100IU/d，肌注；补充水分（E对）以加速钙排泄。补充维生素D的患者可增加日晒，该患儿已经维生素D中毒不可再继续补充维生素D（A对）。